患者，男，30岁。右手掌红肿热痛，整个手掌肿胀高突，掌心失去正常的凹陷，手背肿势明显，疼痛剧烈，红肿蔓延到手臂，伴发热头痛。其诊断是
A. 蛇头疔
B. 蛇眼疔
C. 蛇肚疔
D. 托盘疔
E. 红丝疔

正确答案：D。托盘疔

解析：手足部疔疮主要有蛇眼疔、蛇头疔、蛇肚疔、托盘疔和足底疔，托盘疔，生于手掌心劳宫穴处，肿形如托盘之状，本病例手掌红肿热痛，肿胀高突，符合托盘疔的临床表现（D对）。蛇头疔，生在指头顶端的，肿胀形如蛇头（A错）。蛇眼疔，生于指甲缘，因其色紫而凸，或溃后胬肉高突，形如蛇眼，本病例发病特点与之不符（B错）。蛇肚疔，生于指腹部，肿胀如蛇肚者，本病例发病特点与之不符（C错）。红丝疔，是发生于四肢，皮肤呈红丝显露，迅速向上走窜的急性感染性疾病，相当于西医的急性淋巴管炎，本病例发病特点与之不符（E错）。